自Hesselbach三角向外突出的疝称为
A. 股疝
B. 腹股沟直疝
C. 腹股沟斜疝
D. 脐疝
E. 白线疝

正确答案：B。腹股沟直疝

解析：Hesselbach三角又称直疝三角、海氏三角，位于腹股沟区前下部，由腹直肌外侧缘、腹股沟韧带和腹壁下动脉围成。此处腹壁缺乏完整的腹肌覆盖，且腹横筋膜又比周围部分薄，易发生疝。自Hesselbach三角向外突出的疝称为腹股沟直疝（B对）。股疝（A错）指疝囊通过股环、经股管向卵圆窝突出的疝。腹股沟斜疝（C错）指疝囊经腹股沟管深部（内环）突出，向内、向下、向前斜行经过腹股沟管，再穿出腹股沟管浅环（皮下环），并可进入阴囊的疝。脐疝（P317）（D错）疝囊通过脐环突出的疝称为脐疝。白线疝（P317）（E错）也称上腹疝，指发生于腹壁正中（白线）处的疝，绝大多数在脐上。